肱二头肌的主要作用是
A. 使肩关节外展
B. 使肘关节屈曲
C. 使肘关节伸直
D. 使肩关节旋内
E. 主要运动肩胛骨

正确答案：B。使肘关节屈曲

解析：肱二头肌的主要作用是使肘关节屈曲（B对）。